有关肛门栓剂中药物吸收的表述，正确的有
A. 栓剂使用时塞入越深，药物吸收越好
B. 栓剂的吸收与在直肠的保留时间成正比
C. 一般水溶性大的药物易溶解于体液中，有利于吸收
D. pKa＞10的弱碱性药物，吸收较慢
E. 基质的溶解特性与药物相反时，有利于药物的释放与吸收

正确答案：B、C、D、E。栓剂的吸收与在直肠的保留时间成正比；一般水溶性大的药物易溶解于体液中，有利于吸收；pKa＞10的弱碱性药物，吸收较慢；基质的溶解特性与药物相反时，有利于药物的释放与吸收